结合上皮向根方增殖、延伸，形成深牙周袋，其周围有密集的炎症细胞浸润可提示
A. 天疱疮
B. 慢性复发性腮腺炎
C. 活动期牙周炎
D. 急性化脓性颌骨骨髓炎
E. 舍格伦综合征

正确答案：C。活动期牙周炎

解析：本题考查活动期牙周炎的病理变化。结合上皮向根方增殖、延伸，形成深牙周袋，其周围有密集的炎症细胞浸润可提示活动期牙周炎（C对）。活动期牙周炎的病理变化为结合上皮向根方增殖、延伸，形成深牙周袋，其周围有密集的炎症细胞浸润。